关于偶然误差的说法，正确的是
A. 偶然误差是由偶然原因引起的
B. 正负是固定的
C. 大小不固定
D. 正、负误差概率出现的机率大致相同
E. 绝对值大的误差出现的概率大

正确答案：A、C、D。偶然误差是由偶然原因引起的；大小不固定；正、负误差概率出现的机率大致相同

解析：本题考查偶然误差。偶然误差是由偶然原因引起的（A对），其大小和正负不固定（B错C对），绝对值大的误差出现概率小（E错），绝对值小的误差出现概率大；正、负误差出现概率大致相同（D对）。根据上述偶然误差出现的规律性，通过增加平行测定次数，以平均值作为最后的结果，便可以减小测定的偶然误差。